翼咽间隙又可称为
A. 咽旁前间隙
B. 咽旁后间隙
C. 咽旁间隙
D. 咽后间隙
E. 食管后间隙

正确答案：C。咽旁间隙

解析：咽旁间隙或称咽侧间隙、翼咽或咽翼间隙等。掌握“面侧深区及颌面部各间隙的境界”知识点。